流行病学中的疾病之间分布是指
A. 历史分布，地区分布，职业分布
B. 人群分布，时间分布，地区分布
C. 性别分布，民族分布，地区分布
D. 年龄分布，季节分布，地区分布
E. 年龄分布，性别分布，职业分布

正确答案：B。人群分布，时间分布，地区分布

解析：流行病学所说的疾病的三间分布指的是：人群分布、地区分布和时间分布（B对），这是一个记忆性的题目。